藿香正气散组成中含有的药物是
A. 白术，陈皮
B. 苍术，半夏
C. 大腹皮，人参
D. 桔梗，山药
E. 猪苓，白芷

正确答案：A。白术，陈皮

解析：本题考查藿香正气散的组成。其由大腹皮、白芷、紫苏、茯苓、半夏曲、白术、陈皮、厚朴、苦桔梗、藿香、甘草组成（A对）。方歌：藿香正气腹皮苏，甘桔陈苓朴白术，夏曲白芷加姜枣，风寒暑湿并能除。